患者缺失一颗前牙，其他牙有散在间隙，最好的处理方法是
A. 仅修复缺失牙
B. 修复缺失牙并用光敏修复间隙
C. 作烤瓷冠
D. 拔除有间隙的牙
E. 先正畸关闭间隙后再修复

正确答案：E。先正畸关闭间隙后再修复

解析：该患者缺失一颗前牙需要修复，存在散在间隙需要处理，先正畸关闭间隙后再修复（E对），可同时解决这两个问题，是最好的处理方法。仅修复缺失牙（A错）、作烤瓷冠（C错）都不能处理间隙的问题，所以不是最好的处理方法。间隙的恢复不是直接的三维充填，而是恢复与邻牙正常的邻接关系，与对颌牙的咬合，与牙龈良好的接触关系，用光敏修复间隙（B错）既不利于周围组织健康也是不正确的做法。除非有间隙的牙齿属于拔牙指征，否则不应拔出（D错）；间隙大者可直接进行冠修复，有散在间隙用正畸关闭间隙或将间隙集中再进行冠修复。